Ⅲ型超敏反应的启动因素是
A. 细胞因子
B. 免疫球蛋白
C. 免疫复合物
D. 单核-吞噬细胞
E. 淋巴毒素

正确答案：C。免疫复合物